患者，女，35岁。结婚6年未孕，月经先后不定期，经来腹痛，月经量少，经行不畅，有小血块，经前乳胀，胸闷不舒，舌红，苔薄，脉弦。其中医治法是
A. 滋阴养血，调冲益精
B. 温肾养血，调补冲任
C. 疏肝解郁，养血理脾
D. 燥湿化痰，理气调经
E. 活血化瘀，理气调经

正确答案：C。疏肝解郁，养血理脾

解析：患者为中年女性，结婚6年未孕，属不孕症，月经先后不定期，经来腹痛，月经量少，经行不畅，有小血块，经前乳胀，胸闷不舒，可判断患者为肝气郁结，又结合患者舌苔脉象，舌红苔薄，脉弦，符合其不孕症肝气郁结证，故治法为疏肝解郁，养血理脾（C对）。肾阴虚证 证候∶婚久不孕，月经先期，量少或量多，色红无块，形体消瘦，腰酸，头目眩晕，耳鸣，五心烦热。舌红苔少，脉细数。 治法∶滋阴养血，调冲益精（A错）。肾阳虚证 证候∶婚久不孕，月经后期量少，色淡，或见月经稀发甚则闭经。面色晦暗，腰酸腿软，性欲淡漠，大便不实，小便清长。舌淡苔白，脉沉细。治法∶温肾益气，调补冲任（B错）。